下列中药中药用部位干燥柱头的药材是
A. 红花
B. 西红花
C. 槐花
D. 蒲黄
E. 款冬花

正确答案：B。西红花

解析：本题考查的是花类中药的药用部位。下列中药中药用部位干燥柱头的药材是西红花（B对）。药用部位为完整的花、花序或花的某一部分，这类中药称花类中药。完整的花有的是已开放的，如洋金花、红花（A错）；有的是尚未开放的花蕾，如丁香、金银花。药用花序亦有的是采收未开放的，如款冬花（E错）；有的要采收已开放的，如菊花、旋覆花。而夏枯草实际上采收的是带花的果穗。药用仅为花的某一部分，如西红花系柱头，莲须系雄蕊，玉米须系花柱，松花粉、蒲黄（D错）等则为花粉粒等。槐花（C错）为豆科植物槐的干燥花及花蕾。